治疗肝性脑病的抗震颤麻搏药是
A. 左旋多巴
B. 苯海索
C. 苯扎托品
D. 金刚烷胺
E. 司来吉兰

正确答案：A。左旋多巴

解析：左旋多巴（A对）进入中枢后被脑内左旋芳香族氨基酸脱羧酶脱羧转化为DA，补充纹状体DA不足，产生抗帕金森病作用，另外左旋多巴在脑内转化为DA以后，DA可进一步转化为NA，与伪递质相竞争，纠正神经功能紊乱，使由于肝功能衰竭所致的肝性脑病患者由昏迷转为苏醒。苯海索（B错）阻断中枢胆碱能受体，减弱黑质—纹状体通路中乙酰胆碱的作用和降低网状结构—丘脑及丘脑—皮质投射系统的兴奋性，发挥抗胆碱、抗震颤作用，临床用于治疗帕金森病。苯扎托品（C错）作用近似于阿托品，具有抗胆碱作用，同时还具有抗组胺、局部麻醉作用好大脑皮层抑制作用。金刚烷胺（D错）抗帕金森机制涉及多个环节，包括促进黑质2004U2-纹状体多巴胺能神经末梢释放DA。对运动障碍、震颤等有改善作用。司来吉兰（E错）为选择性中枢神经系统MAO2004U2-B抑制药，能迅速通过血脑屏障，不可逆抑制MAO2004U2-B，降低黑质纹状体内DA的降解，同时又能保护黑质DA神经元，延迟神经元变性，临床与左旋多巴合用，尤适用于伴有症状波动的PD患者。